后天各种因素使体质具有
A. 可变性
B. 连续性
C. 复杂性
D. 普遍性
E. 稳定性

正确答案：A。可变性

解析：后天因素是人体出生之后各种因素的总和，如年龄、膳食、生活起居、劳逸、精神情志、自然社会环境因素、疾病损害、药物治疗等。体质在一生中并非一成不变，而是在后天各种因素的影响下发生变化（A对）。体质的可变性具有两个基本规律，一是机体随着年龄的变化呈现出特有的体质特点；二是机体随着外界因素的运动变化呈现出体质状态的变化（BCDE错）。